龋病修复治疗的目的是
A. 终止病变过程
B. 保护牙髓
C. 恢复牙的形态、功能和美观
D. 维持与周围软、硬组织的正常生理解剖关系
E. 以上均是

正确答案：E。以上均是

解析：本题考查龋病修复治疗的目的。龋病治疗的目的是终止病变发展（A对），保护牙髓（B对），恢复牙齿形态、功能和美观（C对），维持与邻近软硬组织的正常生理解剖关系（D对）。（ABCD均对，故E为本题的正确答案）。